服用螺内酯可能引起
A. 心动过缓
B. 血钾降低
C. 血钾升高
D. 面部潮红
E. 下肢浮肿

正确答案：C。血钾升高

解析：本题考查药物的不良反应。服用螺内酯可能引起血钾升高（C对）。螺内酯为醛固酮受体阻断剂，常见不良反应：①高钾血症；②胃肠道反应：如恶心、呕吐、胃痉挛和腹泻。心动过缓（A错）是利血平的不良反应。血钾降低（B错）是高效利尿药（呋塞米）的不良反应。面部潮红（D错）和下肢浮肿（E错）是二氢吡啶类钙通道阻滞药的不良反应。